乌梅丸的功用是
A. 温脏安蛔
B. 温脾益肾
C. 和胃止呕
D. 清热益气
E. 降逆化痰

正确答案：A。温脏安蛔

解析：乌梅丸功效为温脏安蛔（A对），本方酸、苦、辛并进，使“蛔得酸则静，得辛则伏，得苦则下”。方中附子、干姜、桂枝温脏祛寒，乌梅安蛔，使蛔静痛止，为治疗蛔厥证之代表方，亦治久泻、久痢。